治疗产青霉素酶的金黄色葡萄球菌感染宜选用的药物是
A. 青霉素V
B. 双氯西林
C. 氨苄西林
D. 阿莫西林
E. 替卡西林

正确答案：B。双氯西林

解析：本题考查耐酶青霉素。耐酶青霉素包括双氯西林（B对）和甲氧西林，在临床应用主要用于治疗产青霉素酶的金黄色葡萄球菌的感染。